体育锻炼能促进哪些器官组织的发育
A. 心肺功能
B. 神经精神系统
C. 体格
D. 免疫系统
E. 骨骼系统

正确答案：C。体格